Dane氏颗粒呈球形，直径为
A. 22nm
B. 27nm
C. 32nm
D. 42nm
E. 50nm

正确答案：D。42nm

解析：Dane氏颗粒呈球形，直径为42nm，具有双层衣壳。掌握“乙型肝炎病毒”知识点。